6位侧链具有吸电子的叠氮基团，对酸稳定，口服吸收良好，其抗菌作用与用途类似青霉素V，主要用于呼吸道、软组织等感染，对流感嗜血杆菌的活性更强的药物是
A. 羧苄西林
B. 非奈西林
C. 苯唑西林
D. 阿度西林
E. 哌拉西林

正确答案：D。阿度西林

解析：本题考查阿度西林。6位侧链具有吸电子的叠氮基团，对酸稳定，口服吸收良好，其抗菌作用与用途类似青霉素V，主要用于呼吸道、软组织等感染，对流感嗜血杆菌的活性更强的药物是阿度西林（D对）。羧苄西林（A错）是将氨苄西林分子氨基以羧基替代得到。非奈西林（B错）6位侧链为苯氧丙酰基。苯唑西林（C错）是用3-苯基-5-甲基异噁唑取代甲氧西林的二甲氧基苯得到的药物。哌拉西林（E错）是在氨苄西林6位侧链的氨基上引入极性较大的哌嗪酮酸基团的衍生物。